某女，50岁。患乏力倦怠、食欲不振1年，又见心悸气短、失眠多梦。证属脾虚气弱、心神失养，宜选用的药是
A. 黄精
B. 西洋参
C. 女贞子
D. 黄芪
E. 刺五加

正确答案：E。刺五加

解析：本题考查的是刺五加的主治病证。证属脾虚气弱、心神失养，宜选用的药是刺五加（E对）。刺五加【主治病证】（1）脾虚乏力，食欲不振，气虚浮肿。（2）肾虚腰膝酸软，小儿行迟。（3）心悸气短，失眠多梦，健忘。（4）胸痹心痛，痹痛日久，跌打肿痛。黄精（A错）【主治病证】（1）肺虚燥咳，劳嗽久咳。（2）肾虚精亏之腰膝酸软、须发早白、头晕乏力。（3）气虚倦怠乏力，阴虚口干便燥。（4）气阴两虚，内热消渴。西洋参（B错）【主治病证】（1）阴虚热盛之咳嗽痰血。（2）热病气阴两伤之烦倦。（3）津液不足之口干舌燥，内热消渴。女贞子（C错）【主治病证】（1）肝肾阴虚之头晕目眩、腰膝酸软、须发早白。（2）阴虚发热。（3）肝肾虚亏之目暗不明，视力减退。黄芪（D错）【主治病证】（1）脾胃气虚，脾肺气虚，中气下陷，气不摄血，气虚发热。（2）自汗，盗汗。（3）气血不足所致的疮痈不溃或溃久不敛。（4）气虚水肿、小便不利。（5）气血双亏，血虚萎黄，血痹肢麻，半身不遂，消渴。